有关蛋白质α螺旋结构，错误的是
A. 链内氢键稳定其结构
B. 稳定α螺旋结构的是离子鍵
C. 是二级结构的形式之一
D. 一般蛋白质分子结构中都含有α螺旋
E. 有些侧链R基团不利于α螺旋

正确答案：B。稳定α螺旋结构的是离子鍵

解析：—般蛋白质分子结构中都含有α螺旋（D对），其是二级结构的形式之一（C对），链内氢键稳定其结构（A对）。当蛋白质的侧链R基团很大、负电相斥、正电相斥或是形成刚性五环等不利于α-螺旋的形成（E对）。离子键（即盐键）主要维系蛋白质的四级结构（B错，为本题正确答案）。